我国结核病的流行特点是
A. 低感染率、高患病率、高死亡率、高耐药率和低递降率
B. 高感染率、高患病率、低死亡率、高耐药率和低递降率
C. 高感染率、高患病率、低死亡率、低耐药率和低递降率
D. 高感染率、高患病率、高死亡率、高耐药率和高递降率
E. 高感染率、高患病率、高死亡率、高耐药率和低递降率

正确答案：E。高感染率、高患病率、高死亡率、高耐药率和低递降率